间脑，不包括
A. 上丘脑
B. 底丘脑
C. 背侧丘脑
D. 后丘脑和下丘脑
E. 上丘、下丘

正确答案：E。上丘、下丘

解析：间脑包括背侧丘脑（C对）、底丘脑（B对）、上丘脑（A对）、后丘脑和下丘脑（D对），是仅次于端脑的中枢高级部位。上丘和下丘（E错，为本题正确选项）属于中脑的组成部分。